小肠特有的以环行肌舒缩为主的节律性运动形式是
A. 蠕动
B. 蠕动冲
C. 紧张性收缩
D. 分节运动
E. 容受性舒张

正确答案：D。分节运动